正常小儿，前囟闭合的年龄是
A. 6～8周
B. 3～4个月
C. 7～10个月
D. 1～2岁
E. 2～2.5岁

正确答案：D。1～2岁

解析：前囟出生时约1.0～2.0cm，1～2岁时闭合。掌握“骨骼发育”知识点。